不宜用高压蒸气灭菌的明胶海绵、凡士林、油脂、液体石蜡和各种粉剂等物品的消毒方法是
A. 高压蒸汽灭菌
B. 煮沸消毒法
C. 干热灭菌法
D. 化学消毒法
E. 紫外线消毒

正确答案：C。干热灭菌法

解析：干热灭菌法：用于玻璃、陶瓷等器具，以及不宜用高压蒸气灭菌的明胶海绵、凡士林、油脂、液体石蜡和各种粉剂等物品。掌握“口外消毒和灭菌”知识点。